同时服用可减少铁剂吸收的药物是
A. 硫酸亚铁
B. 维生素C
C. 碳酸氢钠
D. 维生素B₁₂
E. 叶酸

正确答案：C。碳酸氢钠

解析：本题考查铁剂。同时服用可减少铁剂吸收的药物是碳酸氢钠（C对）。抑酸药物影响三价铁转化为二价铁，四环素、考来烯胺等阴离子药可在肠道与铁络合，碳酸氢钠可与二价铁生成难溶性碳酸铁，均影响铁剂的吸收。硫酸亚铁（A错）可使大便颜色变黑。口服铁剂可加用维生素C（B错），胃酸缺乏者与稀盐酸合用有利于铁剂的解离。